关于肾动脉的叙述，正确的是
A. 发出分支至肾上腺
B. 起自腹腔动脉
C. 经肾静脉、肾盂后方入肾门
D. 左、右肾动脉一样长
E. 右肾动脉较左肾动脉短

正确答案：A。发出分支至肾上腺

解析：肾动脉发出肾上腺下动脉至肾上腺（A对）。肾动脉约平第1-2腰椎椎间盘的高度起于腹主动脉（B错）。